维生素D缺乏性佝偻病突击疗法的治疗方法论述中，正确的是
A. 适用于有并发症或不能口服者
B. 每日口服维生素D0.2万～0.4万IU
C. 每日口服维生素D0.4万～0.6万IU
D. 每日口服维生素D0.6万～0.8万IU
E. 以上均正确

正确答案：A。适用于有并发症或不能口服者

解析：突击疗法：有并发症或不能口服者，或重症佝偻病者，可用此法。肌注维生素D20万～30万IU，一般1次即可，1个月后随访若明显好转，改预防量口服维持，若好转不明显，可再肌注1次。掌握“维生素D缺乏性佝偻病”知识点。